细菌性痢疾的肠溃疡特征
A. 溃疡呈环形与肠的长轴垂直
B. 溃疡呈长椭圆形与肠的长轴平行
C. 溃疡呈烧瓶状口小底大
D. 溃疡边缘呈堤状隆起
E. 溃疡表浅呈地图状

正确答案：E。溃疡表浅呈地图状

解析：细菌性痢疾的肠溃疡特征为溃疡表浅，呈地图状（E对）。溃疡呈环形，其长轴与肠的长轴垂直（A错）是肠结核（P356）的病变特征。溃疡呈长椭圆形，其长轴与肠的长轴平行（B错）是肠伤寒（P359）的病变特征。溃疡呈烧瓶状口小底大（C错）是肠阿米巴病（P369）的病变特征。溃疡边缘呈堤状隆起（D错）是癌性溃疡（P210）的病变特征。